易发生内陷的疾病是
A. 痈
B. 流痰
C. 有头疽
D. 瘰疬
E. 红丝疔

正确答案：C。有头疽

解析：有头疽其特点是：局部初起皮肤上即有粟粒状脓头，焮热红肿胀痛，易向深部及周围扩散，脓头相继增多，溃烂之后状如莲蓬蜂窝，易现内陷证（C对）。痈（A错）的特点是：局部光软无头，红肿疼痛，结块范围多在6～9cm，发病迅速，易肿、易脓、易溃、易敛，或有恶寒、发热、口渴等全身症状，一般不会损筋伤骨，也不会造成走黄，内陷证。流痰（B错）的特点是：好发于骨与关节，起病缓慢，初起皮色不变，化脓易迟，溃后不易收口，易成窦道。瘰疬（D错）好发于儿童及青年，多在颈项及耳后，病程缓慢，初起结核如豆，皮色不变，不觉疼痛，以后逐渐长大窜生，脓成时皮色暗红，溃后脓水清晰，夹有败絮状物，往往此愈彼溃，形成窦道。红丝疔（E错）是因手足部皮肤破损，感染邪毒化火，走窜经络，导致四肢红丝显露，迅速向上走窜的急性感染性疾病。其病因是体内有火毒凝聚，外有手足部疔疮、脚湿气糜烂或皮肤破损感染邪毒，邪毒炽盛化火，流注经脉，向上走窜，若火毒走窜迅速，内攻脏腑，可成走黄证。